休息痢，脾阳虚极，肠中寒积不化，遇寒即发，下痢白冻，倦怠少食，舌淡苔白，脉沉。可用
A. 温脾汤
B. 胃苓汤
C. 连理汤
D. 桃花汤
E. 补中益气汤

正确答案：A。温脾汤

解析：脾阳虚极，寒从中生，致肠中寒积不化。寒湿久留，冷积不化，又可导致脾气虚弱，而见下痢白冻，倦怠少食。治疗时应温中散寒，消积导滞，选用功为温中散寒、消积导滞的温脾汤（A对）。胃苓汤健脾和中，利水化湿，主治寒湿内阻，腹痛泄泻，小便不利（B错）。连理汤温中清肠，调气化滞，用于休息痢（C错）。桃花汤温中涩肠，用于脾肾阳虚所致久痢（D错）。补中益气汤补中益气，升阳举陷，用于脾虚气陷证、气虚发热证（E错）。